心尖区触及舒张期震颤，最可能的是
A. 二尖瓣狭窄
B. 二尖瓣关闭不全
C. 主动脉瓣狭窄
D. 室间隔缺损
E. 动脉导管未闭

正确答案：A。二尖瓣狭窄

解析：二尖瓣狭窄（A对）特征性杂音为心尖区舒张中晚期低调的隆隆样杂音，呈递增性，局限，左侧卧位明显，运动或用力呼气可使其增强，常伴舒张期震颤。二尖瓣关闭不全（B错）的典型杂音为心尖区全收缩期吹风样杂音，杂音强度≥3/6级，可伴收缩期震颤；主动脉瓣狭窄（C错）典型杂音为胸骨右缘1、2肋间粗糙响亮的射流性杂音；室间隔缺损（D错）可闻及全收缩期杂音伴震颤，大型室间隔缺损有时可闻及因继发性肺动脉瓣关闭不全而致的舒张期杂音；动脉导管未闭（E错）可因分流量不同，有不同临床表现，突出的体征为胸骨左缘第二肋间及左锁骨下方可闻及连续性机械样杂音。